男，55岁。心房颤动5年，1年前曾发作语言不利伴肢体活动障碍。该患者长期抗栓治疗的药物首选是
A. 阿司匹林
B. 尿激酶
C. 低分子肝素
D. 潘生丁
E. 华法林

正确答案：E。华法林

解析：患者有心房颤动的病史，出现语言不利伴肢体活动障碍，考虑是房颤伴发了脑栓塞，需要长期的抗栓治疗，首选口服华法林（E对）。阿司匹林、潘生丁是抗血小板药（AD错）而不是抗栓药，主要用于预防和治疗冠张动脉硬化性心脏病和缺血性脑血管病等。尿激酶是纤维蛋白溶解药（B错）而不是抗栓药。低分子肝素（C错）是凝血酶间接抑制药，只能皮下注射，长期使用并非首选。